女，35岁。停经80天，阴道不规则流血4天，下腹隐痛，呕吐反应剧烈，既往无孕产史。妇科检查：宫底平脐，质软，未触及胎体，未闻及胎心，尿hCG（+）。该患者首选的辅助检查是
A. 血β-hCG
B. 胸部X线片检查
C. 凝血功能检查
D. 盆腔超声检查
E. 颅脑CT检查

正确答案：D。盆腔超声检查

解析：患者为年轻女性，停经80天（怀疑早孕），阴道不规则流血4天（葡萄胎患者般在停经8～12周左右开始不规则阴道流血，量多少不定），下腹隐痛（因葡萄胎增长迅速和子宫过度快速扩张引起阵发性下腹痛，一般不剧烈，能忍受）。呕吐反应剧烈（提示早孕反应），妇科检查：宫底平脐（为22周左右的子宫大小，大于停经月份。因葡萄胎迅速增长及宫腔内出血，约半数以上患者的子宫大于停经月份，质地变软），质软，未触及胎体，未闻及胎心（葡萄胎患者B超检查，无妊娠囊或胎心搏动），尿hCG（+），应首先考虑的诊断是葡萄胎。B型超声是诊断葡萄胎的一项可靠和敏感的辅助检查，通常采用经阴道彩色多普勒超声。所以该患者首选的辅助检查是盆腔超声检查（D对）。血β-hCG（A错）不是首选诊断手段。胸部X线片检查（B错）、凝血功能检查（C错）、颅脑CT检查（E错）均不是葡萄胎的诊断手段。